女，28岁。肛门持续剧痛1天。查体：T36.5℃，P80次／分，BP120/80mmHg，双肺呼吸音清，未闻及干湿性啰音，心律齐，腹软，无压痛，未触及包块，肛门口有直径0.8cm的肿物。呈暗紫色、质硬，触痛明显，最可能的诊断是
A. 内痔脱出
B. 肛周脓肿
C. 肛裂
D. 直肠息肉
E. 血栓性外痔

正确答案：E。血栓性外痔

解析：青年女性，肛门持续剧痛1天，肛门口有直径0.8cm的肿物，呈暗紫色、质硬，触痛明显（血栓性外痔典型表现），最可能的诊断是血栓性外痔（E对）。直肠息肉（D错）（P386）临床表现为反复发作的腹痛和肠道出血。肛裂（C错）（P398）肛裂临床表现为典型的疼痛、便秘和出血，疼痛多剧烈，有典型周期性。肛周脓肿（B错）（P400）临床表现为肛周持续性跳动性疼痛，全身感染症状不明显，病变处明显红肿，有硬结和压痛，脓肿形成可有波动感，穿刺易抽出脓液。内痔脱出（A错）（P404）临床表现为便后出鲜血。